正常终尿约占肾小球超滤液量的
A. 0.01
B. 0.05
C. 0.1
D. 0.15
E. 0.2

正确答案：A。0.01